强心苷治疗心衰的药理基础是
A. 兴奋窦房结
B. 加强心肌收缩力
C. 抑制房室传导，延长房室结的ERP
D. 缩短心房的ERP
E. 减少心输出量

正确答案：B。加强心肌收缩力

解析：强心苷增强心肌收缩性，使心输出量增加，从而改善动脉系统缺血。强心苷对不同原因引起的心功能不全有不同程度的疗效∶对伴有心房颤动或心室率过快的慢性心功能不全疗效最好；对心瓣膜病、先天性心脏病、动脉硬化及高血压引起的心力衰竭效果良好（B对）。